一般毒性作用根据接触毒物的时间的长短又可分为急性毒性、（）和慢性毒性
A. 致突变毒性
B. 生殖毒性
C. 免疫毒性
D. 亚慢性毒性

正确答案：D。亚慢性毒性

解析：本题考查一般毒性作用根据接触毒物时间长短的分类。按接触毒物的时间长短，一般毒性作用可分为急性毒性、亚急性毒性、亚慢性毒性（D对ABC错）和慢性毒性作用。